评价他汀类药物调节血脂作用的终点研究是
A. 冠脉综合征
B. 美尼尔综合征
C. 更年期综合征
D. 震颤麻痹综合征
E. 心脑血管事件

正确答案：A。冠脉综合征

解析：本题考查调血脂药的不良反应。目前对于降脂治疗的重点从特定的治疗目标值转移到了风险评估上来，主要强调他汀类药物在降低急性冠脉综合征（A对）（ACS）风险方面的获益。心脑血管事件（E错）是评价阿司匹林抗血小板作用的终点研究。